判定良性与恶性肿瘤，最具诊断意义的是
A. 肿瘤细胞的异型性
B. 生长速度
C. 对机体影响
D. 生长方式
E. 出血与坏死

正确答案：A。肿瘤细胞的异型性

解析：肿瘤细胞的异型性（A对）是指肿瘤组织结构和细胞形态与相应的正常组织有不同程度的差异，是判定良性与恶性肿瘤最具诊断意义的指标，良性肿瘤的异型性小，恶性肿瘤的异型性大。生长速度（B错）、对机体影响（C错）和生长方式（D错）也是良性肿瘤与恶性肿瘤的区别点，但都不是最具诊断意义的。出血与坏死（E错）是恶性肿瘤常见的继发改变，但在良性肿瘤中也偶见（如子宫黏膜下肌瘤）。